小脑病损时可能出现的体征是
A. Brudzinski征
B. Babinski征
C. Romberg征
D. Kernig征
E. Weber综合征

正确答案：C。Romberg征

解析：Romberg征（C对）即闭目难立征。检查方法：患者双足并拢直立，双手向前平伸、闭目。如果出现摇摆甚至跌倒，则为Romberg征阳性提示小脑病损。Babinski征（B错）是经典的病理反射，提示锥体束受损。Brudzinski征（A错）和Kernig征（D错）均为脑膜刺激征，提示腰骶节段的脊神经根受刺激，可见于脑膜炎、蛛网膜下腔出血、脑水肿等（P119）。Weber综合征（E错）即大脑脚综合征，见于一侧中脑大脑脚脚底损害（P16）。